女，25岁。头晕、乏力2个月。既往体健，近1年来月经量明显增多。实验室检查：Hb95g/L，RBC3.5×10¹²/L，红细胞大小不等，中心淡染区扩大，WBC4.5×10⁹/L，plt310×10⁹/L，粪隐血（-）。最根本的治疗措施是
A. 治疗妇科疾病
B. 给予雄性激素
C. 给予铁剂
D. 给予糖皮质激素
E. 给予维生素B₁₂及叶酸

正确答案：A。治疗妇科疾病

解析：根据患者血象可诊断为贫血，且有“月经量增多一年”病史，判断贫血的原因来自于月经量增多导致的失血性贫血。可对其采用补充铁剂等对症治疗，但最根本的措施是治疗原发病，即控制月经量，寻找经量过多的病因，最根本的治疗措施是治疗妇科疾病（A对）。给予雄性激素（B错）、给予铁剂（C错）、给予糖皮质激素（D错）、给予维生素B12及叶酸（E错）均为对症治疗，治标不治本，故不是最根本的治疗。